患者，男，50岁。胃脘部经常隐隐作痛，时泛吐清水，喜暖恶寒，按之痛减，纳差神疲，大便溏，舌苔白，脉弱。治疗除取章门、内关、足三里穴外，还应取
A. 脾俞、肝俞、下脘
B. 脾俞、胆俞、上脘
C. 脾俞、胃俞、中脘
D. 胃俞、肝俞、三阴交
E. 胃俞、胆俞、上巨虚

正确答案：C。脾俞、胃俞、中脘

解析：患者胃痛，并呈现出脾胃虚寒的证型，当补益脾胃，故当选用相应的俞募穴（C对）。肝俞、下脘不能补益脾胃（A错）。胆俞、上脘不能止呕，亦不能补益脾胃（B错）。肝俞为肝之背募穴，本病与肝无关（D错）。上巨虚不可治胃痛（E错）。